关系到居室内空气清洁，便于人们放置家具摆设，有足够的活动范围，避免过分拥挤和减少传染病的传播机会的一项重要的居室规模指标是
A. 居室容积
B. 居室面积
C. 居室净高
D. 居室进深
E. 居室通风

正确答案：B。居室面积

解析：本题考查居室面积。居室面积（B对ACDE错）又称居住面积，它关系到居室内空气清洁，便于人们放置家具摆设，有足够的活动范围，避免过分拥挤和减少传染病的传播机会。